新斯的明治疗重症肌无力的机制是
A. 兴奋大脑皮质
B. 激动骨骼肌M胆碱受体
C. 促进乙酰胆碱合成
D. 抑制胆碱酯酶和激动骨骼肌N2胆碱受体
E. 促进骨骼肌细胞Ca²⁺内流

正确答案：D。抑制胆碱酯酶和激动骨骼肌N2胆碱受体

解析：重症肌无力是一种自身免疫性疾病，体内产生抗N₂受体的抗体，使神经肌肉传递功能障碍，骨骼肌呈进行性收缩性无力，新斯的明兴奋骨骼肌的作用很强，皮下注射可缓解肌无力症状，其主要机制为除了抑制胆碱酯酶外，还能直接兴奋骨骼肌运动终板上的N₂胆碱受体（D对）以及促进运动神经末梢释放乙酰胆碱，加强神经肌肉传导，而不能促进乙酰胆碱合成（C错）。新斯的明的结构中含有季铵基团，脂溶性低，不易透过血脑屏障，无明显的中枢作用，不能兴奋大脑皮质（A错）。新斯的明属于可逆性的胆碱酯酶抑制剂，通过与胆碱酯酶结合，形成牢固的复合物，水解缓慢，使酶的结合部位被占领而失去活性，不能水解乙酰胆碱，从而使乙酰胆碱堆积激动M、N受体，表现出M以及N样作用，并不能直接激动骨骼肌M胆碱受体（B错）。新斯的明作用于胆碱酯酶，不直接作用于骨骼肌钙离子通道，促进骨骼肌细胞Ca²⁺内流（E错）。